下列哪项不是决定分娩难易的重要因素
A. 胎方位
B. 胎心率
C. 胎儿大小
D. 骨盆大小
E. 产力强弱

正确答案：B。胎心率